在生命质量评价中，用来测定患者整个生命质量水平的是
A. 满意度
B. 幸福感
C. 认知功能
D. 情绪反应
E. 社会功能

正确答案：B。幸福感